骨关节炎最常累及的关节是
A. 腕关节，踝关节，远端指间关节
B. 膝关节，肩关节，近端指间关节
C. 腕关节，肘关节，近端指间关节
D. 膝关节，髋关节，远端指间关节
E. 掌指关节，远端指间关节，近端指间关节

正确答案：D。膝关节，髋关节，远端指间关节

解析：骨性关节炎最常累及膝关节，髋关节，以及手指远端指间关节（D对）。腕关节、踝关节、肘关节、近端指间关节较少受累（ABCE错）。